对感染艾滋病病毒的孕产妇无偿提供预防艾滋病母婴传播的服务是
A. 无偿用血
B. 家庭接生
C. 终止妊娠
D. 产前指导
E. 基因诊断

正确答案：D。产前指导

解析：医疗卫生机构应当按照国务院卫生主管部门制定的预防艾滋病母婴传播技术指导方案的规定，对孕产妇提供艾滋病防治咨询和检测，对感染艾滋病病毒的孕产妇及其婴儿，提供预防艾滋病母婴传播的咨询、产前指导（D对）、阻断、治疗、产后访视、婴儿随访和检测等服务。无偿用血（A错）、家庭接生（B错）、终止妊娠（C错）和基因诊断（E错）为有偿服务或非能有效预防艾滋病母婴传播的服务。